药斗的排列有一定的规律和要求，其中因饮片外观性状相似但功效不同，不宜排列在一起的有
A. 紫苏子与菟丝子
B. 蒲黄与海金沙
C. 酒黄精与盐知母
D. 蛇床子与地肤子
E. 炙甘草与炙黄芪

正确答案：A、B、D、E。紫苏子与菟丝子；蒲黄与海金沙；蛇床子与地肤子；炙甘草与炙黄芪

解析：本题考查饮片斗谱安排。外观形状相似，但功效不同，不宜装于一个药斗的是：蒲黄与海金沙（B对）、紫苏子与菟丝子（A对）、炙甘草与炙黄芪（E对）、蛇床子与地肤子（D对）。外观性状相似的饮片，尤其是外观性状相似但功效不同的饮片，不宜排列在一起。如蒲黄与海金沙，紫苏子与菟丝子，山药与天花粉，苦杏仁与桃仁，厚朴与海桐皮，荆芥与紫苏叶，大蓟与小蓟，炙甘草与炙黄芪，当归与独活，制南星与象贝（浙贝），菟丝子与苏子，熟地与黄精，知母与玉竹，蛇床子与地肤子，玫瑰花与月季花，血余炭与干漆炭，韭菜子与葱子等。